在多中心人体试验审查中，项目总负责人单位伦理委员会审查通过后，项目参加单位的伦理委员会应当
A. 重新审查
B. 不再审查
C. 只审查本单位的可行性
D. 只审查方案的科学性
E. 只审查受试者的知情同意书

正确答案：C。只审查本单位的可行性

解析：多中心试验，指由一个单位的主要研究者总负责，多个单位的研究者合作，按同一个试验方案同时进行的临床试验。多中心研究的伦理审查应由项目总负责人单位的伦理委员会进行科学和伦理的审查，参加项目的单位伦理委员会只审查在本单位的可行性（C对）。